毛果芸香碱可引起
A. 血压升高
B. 瞳孔扩大
C. 骨骼肌松弛
D. 腺体分泌增加
E. 心脏兴奋性下降

正确答案：D。腺体分泌增加

解析：本题考查毛果芸香碱的作用。毛果芸香碱可引起腺体分泌增加（D对）。较大剂量的毛果芸香碱（10～15mg皮下注射）可使汗腺、唾液腺分泌明显增加，也可使泪腺、胃腺、胰腺、小肠腺体和呼吸道黏膜分泌增加。毛果芸香碱0.1mg/kg静脉注射时，可使心率和血压短暂下降（A错）。毛果芸香碱可激动瞳孔括约肌的M胆碱受体，表现为瞳孔缩小（B错）。毛果芸香碱不影响骨骼肌（C错）和心脏（E错）。